关节腔内的滑液主要来自
A. 关节软骨
B. 关节囊纤维层
C. 关节囊滑膜层
D. 滑膜囊
E. 关节内软骨

正确答案：C。关节囊滑膜层

解析：关节腔内的滑液主要来自关节囊滑膜层（C对）。